用于防治心绞痛的药物是
A. 地高辛
B. 奎尼丁
C. 两者皆有效
D. 两者皆无效

正确答案：D。两者皆无效

解析：本题考查用于防治心绞痛的药物。地高辛为强心苷类正性肌力药，用于急、慢性心力衰竭，控制心房颤动，心房扑动引起的快速心室率，室上性心动过速，不用于心绞痛的防治。奎尼丁为钠通道阻滞剂，为广谱抗心律失常药，不用于心绞痛的防治（D对）。